处理医疗事故，应当遵循的原则是公正，公平，公开以及下列
A. 及时，利民
B. 准确，利民
C. 便民，准确
D. 及时，便民
E. 准确，及时

正确答案：D。及时，便民

解析：根据《医疗事故处理条例》第一章第三条规定，处理医疗事故，应当遵循公开、公平、公正、及时、便民（D对）的原则，坚持事实就是的科学态度，做到事实清楚、定性准确、责任明确、处理恰当。